小儿感冒容易出现兼证，多见
A. 夹火、夹痰、夹湿
B. 夹火、夹痰、夹滞
C. 夹风、夹痰、夹滞
D. 夹惊、夹痰、夹滞
E. 夹湿、夹惊、夹滞

正确答案：D。夹惊、夹痰、夹滞

解析：由于小儿肺脏娇嫩，感邪之后，肺气失宣，气机不利，津液不得敷布而内生痰液，痰壅气道，则咳嗽加剧，喉间痰鸣，此为感冒夹痰；小儿脾常不足，感邪之后，脾运失司，稍有饮食不节，致乳食停积，阻滞中焦，则脘腹胀满，不思乳食，或伴呕吐、泄泻，此为感冒夹滞；小儿神气怯弱，感邪之后，热扰心肝，易致心神不宁，睡卧不实，惊惕抽搐，此为感冒夹惊，故小儿感冒容易出现兼证，多见夹惊、夹痰、夹滞（D对）。